临终关怀的伦理意义表现在
A. 它有利于建立和谐社会
B. 它体现生命神圣、质量和价值的统一
C. 它理解临终病人的需求
D. 它维护临终病人的生命尊严
E. 它同情和关心临终病人的家属

正确答案：B。它体现生命神圣、质量和价值的统一

解析：临终关怀的伦理意义：体现了医学人道精神，体现了人的生命神圣、质量和价值的统一，彰显了人类的文明和进步。掌握“临终关怀伦理”知识点。